南瓜子杀虫的用法是
A. 生用，水煎服
B. 生用，研末服
C. 炒用，水煎服
D. 炒用，研末服
E. 水煎，熬膏服

正确答案：B。生用，研末服

解析：本题考查南瓜子的用法用量。南瓜子杀虫的用法是生用，研末服（B对）。南瓜子【功效】杀虫。【用法用量】内服：生用连壳或去壳后研细粉，60～120g，冷开水调服；也可去壳取仁嚼服。外用：适量，煎水熏洗。治血吸虫病，须生用大量久服。榧子【功效】杀虫，消积，润肠通便，润肺止咳。【用法用量】内服：煎汤，9～15g，连壳生用（A错），打碎人煎；嚼服，每次15g，炒熟去壳。贯众【功效】杀虫，清热解毒，止血。【用法用量】内服：煎汤，4.5～9g；或入丸散。驱虫及清热解毒宜生用，止血宜炒炭（C错）用。